下列表现属于Babinski征的是
A. 四指轻度掌屈
B. 拇指背伸，余趾扇形展开
C. 屈颈检查抵抗力增强
D. 伸膝受阻伴疼痛
E. 头屈曲时，双髋及膝关节同时屈曲

正确答案：B。拇指背伸，余趾扇形展开

解析：Babinski征是经典的病理反射，提示锥体束受损。检查方法为：用竹签轻划患者足底外侧，自足跟向前至小趾根部足掌时旋转向内侧。阳性反应为拇指背伸，余趾扇形展开（B对）。四指轻度掌屈（A错）见于生理性的跖反射（P118）。屈颈检查抵抗力增强（C错）、伸膝受阻伴疼痛（D错）、头屈曲时，双髋及膝关节同时屈曲（E错）三者分别为脑膜刺激征的颈强直（P119）、克匿格征（P119）、布鲁津斯基征（P120）。